下列疾病均表现为干性咳嗽，但应除外哪一项疾病
A. 急性咽喉炎
B. 慢性支气管炎
C. 胸膜炎
D. 轻症肺结核
E. 急性支气管炎初期

正确答案：B。慢性支气管炎

解析：咳嗽无痰或痰量极少，称为干性咳嗽，干咳或刺激性咳嗽常见于急性或慢性咽喉炎（A对）、喉癌、急性支气管炎初期（E对）、气管受压、支气管异物、支气管肿瘤、胸膜疾病（C对）、原发性肺动脉高压以及二尖瓣狭窄等。咳嗽伴有咳痰称为湿性咳嗽，常见于慢性支气管炎（B错，为本题正确答案）、支气管扩张、肺炎、肺脓肿和空洞型肺结核。轻症肺结核（D对）咳嗽较轻、干咳或少量粘液痰。